抗菌活性强并对β-内酰胺酶高度稳定，属于碳青霉烯类的抗菌药物是
A. 头孢吡肟
B. 头孢美唑
C. 亚胺培南
D. 氨曲南
E. 拉氧头孢

正确答案：C。亚胺培南

解析：本题考查碳青霉烯类的抗菌药物。亚胺培南（C对）抗菌活性强并对β-内酰胺酶高度稳定，属于碳青霉烯类的抗菌药物。头孢美唑（B错）为头霉素类。氨曲南（D错）为单酰胺菌素类。拉氧头孢（E错）为氧头孢烯类。